患者，男性，32岁。有免疫缺陷，近期高热，诊断为革兰阴性杆菌败血症，宜选用
A. 红霉素
B. 氨苄青霉素
C. 阿米卡星+头孢曲松
D. 链霉素
E. 多黏菌素

正确答案：C。阿米卡星+头孢曲松